下列关于甲状腺检查说法错误的是
A. 甲状腺肿大Ⅱ度，能看到肿大，又能触及，但不超过胸锁乳突肌
B. 甲状腺肿大常可听到低调的连续性血管杂音
C. 甲亢时肿大的甲状腺质地多较柔软
D. 甲状腺癌触诊时，包块有结节感、不规则、质硬
E. 甲状腺癌触诊时可摸到颈总动脉搏动

正确答案：E。甲状腺癌触诊时可摸到颈总动脉搏动

解析：甲状腺肿大可分为三度：不能看出肿大但能触及者为Ⅰ度；既可看出肿大又能触及，但不超过胸锁乳突肌为Ⅱ度（A对）；肿大超出胸锁乳突肌外缘者为Ⅲ度。甲亢时肿大的甲状腺质地多较柔软（C对），由于血管增多、增粗且血流加快，故常可听到低调的连续性血管杂音（B对）。甲状腺癌触诊时包块常呈不规则结节，质硬而固定，易与周围组织粘连（D对）。由于甲状腺癌常将颈总动脉包绕在癌组织内，腺体后缘不能触及颈总动脉搏动（E错，为本题正确答案）。